产后常规检查胎盘见其边缘有凝血块压迹者，应首先考虑的诊断是
A. 胎盘早剥
B. 先兆子宫破裂
C. 先兆早产
D. 过期妊娠
E. 双胎

正确答案：A。胎盘早剥

解析：患者产后常规检查胎盘见其边缘有凝血块压迹，考虑胎盘早剥Ⅰ度，并结合临床（A对）。先兆子宫破裂主要表现为：1.产妇可见明显下腹痛，烦躁不安，脉搏、呼吸加快，排尿困难或可见血尿，也可伴有阴道流血。2.产程延长，子宫体部强直性收缩，下段伸展变薄，有压痛，按压疼痛，拒绝按压及触摸，阵缩时子宫下段隆起，在子宫体部与下段间形成环状的病理性缩复环，使子宫呈葫芦形，此病理性缩复环随产程延长而渐渐升高。3.胎动次数增多，胎心率不稳，变快、变慢或快慢不均（B错）。先兆早产的症状有不规则或规则的子宫收缩，伴有宫颈管的进行性缩短，常伴有少许阴道流血或血性分泌物（C错）。妊娠达到或超过42周，称为过期妊娠（D错）。双胎即指双胞胎（E错）。